Th2细胞不分泌
A. IL-2
B. IL-5
C. IL-4
D. IL-10
E. IL-13

正确答案：A。IL-2